判定溶剂的极性大小是
A. 分离因子
B. 比表面积
C. 介电常数
D. 熔距
E. 比旋光度

正确答案：C。介电常数

解析：本题考查的是极性及其强弱判断。判定溶剂的极性大小是介电常数（C对）。极性及其强弱判断：极性强弱是支配物理吸附过程的主要因素。所谓极性乃是一种抽象概念，用以表示分子中电荷不对称的程度，并大体上与偶极矩、极化度及介电常数等概念相对应。溶剂的极性可以大体根据介电常数（ε）的大小来判断。分离因子β（A错）是液液萃取是判断物质分离难易的重要参数。一般β＞50时，简单萃取即可解决问题，但β＜50时，则宜采用逆流分溶法。比表面积（B错）为影响大孔吸附树脂法吸附的原因之一。影响大孔吸附树脂法吸附的因素：大孔吸附树脂本身的性质是重要的影响因素之一，如：比表面积、表面电性、能否与化合物形成氢键等。洗脱剂的性质是另一个影响因素。化合物的性质也是影响吸附的重要因素。熔距（D错）：是指晶体从开始收缩到完全熔化或分解的温度差。一般单一化合物的熔距很窄，在1℃～2℃的范围内。可用以判断结晶的纯度。比旋光度（E错）即比旋度，为挥发油等的物理常数。